肾脏损伤不出现的临床表现是
A. 排尿困难
B. 膀胱刺激征
C. 尿潴留
D. 高血压
E. 尿外渗

正确答案：B。膀胱刺激征

解析：肾脏受损没有损及膀胱，不会出现膀胱刺激征（B对）；影响排尿功能会引起排尿困难（A错）；贮尿困难引起尿潴留（C错）、尿外渗（E错）；由于水液代谢问题引起肾性高血压（D错）。